《中华人民共和国药品管理法》规定的药品是指用于
A. 防病、治病的特殊商品
B. 预防、治疗人的疾病的物质
C. 预防、诊断人的疾病的物质
D. 预防、治疗、诊断人的疾病的物质
E. 预防、治疗、诊断人及动物疾病的物质

正确答案：D。预防、治疗、诊断人的疾病的物质

解析：药品是指用于预防、治疗、诊断人的疾病，有目的地调节人的生理机能并规定有适应证或者功能主治、用法和用量的物质，包括中药材、中药饮片、中成药、化学原料药及其制剂、抗生素、生化药品、放射性药品、血清、疫苗、血液制品和诊断药品等。掌握“药品管理及法律责任”知识点。